《中华人民共和国刑法》规定生产、销售假药，致人死亡或对人体健康造成特别严重危害的
A. 处十年以上有期徒刑、无期徒刑或死刑，并处以罚金或没收财产
B. 处七年以上有期徒刑或者无期徒刑，并处以罚金或没收财产
C. 处七年以下有期徒刑，并处以罚金
D. 处三年以上十年以下有期徒刑，并处以罚金
E. 处五年以下有期徒刑，并处以罚金

正确答案：A。处十年以上有期徒刑、无期徒刑或死刑，并处以罚金或没收财产

解析：本题考查生产、销售假药的法律责任。根据《刑法》第一百四十一条规定，生产、销售假药的，处三年以下有期徒刑或者拘役，并处罚金；对人体健康造成严重危害或者有其他严重情节的，处三年以上十年以下有期徒刑，并处罚金；致人死亡或者有其他特别严重情节的，处十年以上有期徒刑、无期徒刑或者死刑，并处罚金或者没收财产（A对）。